不是儿童期发育特点的是
A. 大约10年
B. 身体智力发展最快的时期
C. 加强营养
D. 生殖器官发育也最快
E. 易发生外阴阴道炎

正确答案：D。生殖器官发育也最快

解析：本题考查儿童期的发育特点。生殖器官在进入青春期后迅速发育（D错，为本题正确答案）。儿童通常为婴儿期至10岁，大约10年（A对），是身体智力发展最快的时期（B对），所以需要加强营养（C对），在此阶段女童易发生外阴阴道炎（E对）。